全口义齿的试戴何时进行
A. 确定完（牙合）位关系，上好（牙合）架后
B. 排列完前牙后
C. 排列完前牙后
D. 义齿排牙、上蜡完成后
E. 义齿完成后

正确答案：D。义齿排牙、上蜡完成后

解析：本题考查全口义齿试戴的时间。试戴义齿排牙、上蜡完成后（D对）进行，若发现问题可及时修改或返工，此时义齿还处在蜡型阶段，容易修改，以免造成全口义齿的最终失败，对于患者来说可以节省治疗时间和费用。